下列哪项不是八正散主治证的症状
A. 小腹急满
B. 小便涩痛
C. 恶心呕吐
D. 舌苔黄腻
E. 脉数有力

正确答案：C。恶心呕吐

解析：根据考点还原可做出判断。八正散主治症中没有恶心呕吐（C对）。小腹急满由湿热郁遏，气机不畅所致（A错）。小便涩痛由湿热下注蕴于膀胱，水道不通所致（B错）。舌苔黄腻由湿热蕴蒸所致（D错）。脉数有力由湿热充斥脉道所致（E错）。